隔离层包衣过程应选择的材料
A. 丙烯酸树脂Ⅱ号
B. 羟丙基甲基纤维素
C. 玉米朊乙醇溶液
D. 滑石粉
E. 川蜡

正确答案：C。玉米朊乙醇溶液

解析：本题考查片剂的包衣。隔离层包衣过程应选择的材料是玉米朊乙醇溶液（C对）。包衣的基本类型包括糖包衣、薄膜包衣和压制包衣等。糖包衣主要包括隔离层、粉衣层、糖衣层。隔离层常用的材料有：玉米朊乙醇溶液、邻苯二甲酸醋酸纤维素乙醇溶液以及明胶浆等。滑石粉（D错）为粉衣层材料；羟丙基甲基纤维素（B错）为胃溶型薄膜包衣材料；丙烯酸树脂类（Ⅰ、Ⅱ、Ⅲ类）（A错）为肠溶型薄膜包衣材料；川蜡（E错）为打光包衣的材料。